树脂与牙、金属等形成粘接形成很强的粘结力的机制
A. 化学结合
B. 氢键结合
C. 相互混合
D. 分子间结合
E. 嵌合

正确答案：B。氢键结合

解析：氢键结合：粘接剂中的氢原子和被粘物表面的氧化物之间可以形成氢键结合，并可成为很强的粘结力。掌握“修复材料、金瓷结合及树脂粘结机制”知识点。